易发生腹疝的作业是
A. 井下作业
B. 教学
C. 长期站立作业
D. 计算机操作
E. 青少年从事重体力劳动

正确答案：E。青少年从事重体力劳动